以下哪项不是乳头状瘤的类型
A. 鳞状细胞乳头状瘤
B. 嗜酸性淋巴肉芽肿
C. 免疫缺陷患者的乳头瘤病
D. 尖锐湿疣
E. 寻常疣

正确答案：B。嗜酸性淋巴肉芽肿

解析：乳头状瘤主要包含以下三种：鳞状细胞乳头状瘤和寻常疣；尖锐湿疣；免疫缺陷患者的乳头瘤和乳头瘤病。掌握“乳头状瘤及牙龈瘤”知识点。